引起着色性干皮病的原因是
A. DNA上T⌒T聚体的切除修复系统有缺陷
B. 细胞膜通透性缺陷引起迅速失水
C. 紫外光照射诱导了有毒性的前病毒
D. 温度敏感性转移酶失活
E. 维生素B1缺乏

正确答案：A。DNA上T⌒T聚体的切除修复系统有缺陷